某中学的校医，每学期都会给所有在校学生检查一次视力，视力表摆放在校医室。视力表和灯箱悬挂在无窗的白墙上，最末一行E字与多数学生的两眼
A. 成30°
B. 成10°
C. 同一水平
D. -10°
E. -30°

正确答案：C。同一水平